某男60岁，误服大量的对乙酰氨基酚，为防止肝坏死，可选用的解毒药物是
A. 谷氨酸
B. 甘氨酸
C. 缬氨酸
D. N-乙酰半胱氨酸
E. 胱氨酸

正确答案：D。N-乙酰半胱氨酸

解析：本题考查对乙酰氨基酚。误服大量的对乙酰氨基酚，为防止肝坏死，可选用的解毒药物是N-乙酰半胱氨酸（D对）。N-乙酰半胱氨酸可通过巯基与毒性代谢产物N-乙酰亚胺醌结合使其失活，阻止其与肝细胞的大分子共价结合而解毒。谷氨酸（A错）、甘氨酸（B错）、缬氨酸（C错）、胱氨酸（E错）分子结构中不含有巯基，不能用于预防对乙酰氨基酚引起的肝坏死。